最可能导致胎儿生长受限的主要危险因素是
A. 母体双阴道单子宫
B. 两次刮宫史
C. 子宫发育畸形
D. 孕妇年龄小于35岁
E. 合并卵巢小囊肿

正确答案：C。子宫发育畸形

解析：胎儿生长受限的主要危险因素有：1.孕妇因素，包括营养因素、妊娠并发症与合并症、其他如孕妇年龄过大（大于35岁）（D错）或过小（小于16）、地区、体重、身高、经济状况、子宫发育畸形（C对）、吸烟、酗酒、宫内感染等；2.胎儿因素；3.胎盘因素；4.脐带因素。母体双阴道单子宫（A错）（P278）主要影响胎儿娩出；多次刮宫史（B错）（P384）可引起继发不孕；合并卵巢小囊肿（E错）一般并不影响卵巢功能，故不是胎儿生长受限的危险因素。